侧腭突来源于
A. 上颌突
B. 下颌突
C. 侧鼻突
D. 球状突
E. 中鼻突

正确答案：A。上颌突

解析：腭部主要由两个前腭突和两个侧腭突发育而来。前腭突来自中鼻突的球状突，侧腭突来自上颌突。开始时侧腭突很快即向下或垂直方向生长，位于舌的两侧，至胎儿第8周时，侧腭突发生向水平方向的转动并向中线生长。左右侧腭突与前腭突自外向内、向后方逐渐联合。两个前腭突和两个侧腭突联合的中心处，留下切牙管或鼻腭管，为鼻腭神经的通道。掌握“面部的发育”知识点。